强心苷治疗心房扑动的药理学基础是
A. 抑制房室传导
B. 加强心肌收缩力
C. 抑制窦房结
D. 缩短心房的有效不应期
E. 加快房室传导

正确答案：D。缩短心房的有效不应期